女，70岁。胃癌根治后7天。因肺部感染，突发剧烈咳嗽后出现腹部手术切口疼痛，有多量淡红色溢出液，该患者可能发生的并发症是
A. 切口感染
B. 腹部切口疝
C. 切口内血肿
D. 切口脂肪液化
E. 切口裂开

正确答案：E。切口裂开

解析：老年女性，胃癌根治后7天（切口裂开常发生于术后1周之内）。因肺部感染，突发剧烈咳嗽后出现腹部手术切口疼痛（腹腔内压力突然增高的动作，如剧烈咳嗽，或严重腹胀是切口裂开的原因），有多量淡红色溢出液。结合该患者病史、临床表现，该患者考虑诊断为切口裂开（E对）。切口感染（A错）表现为伤口局部的红、肿、热、疼痛和触痛。腹部切口疝（P316）（B错）主要症状是腹壁切口处逐渐膨隆，有肿块出现。切口内血肿（C错）表现为切口部位不适感，肿胀和边缘隆起、变色，血液有时经皮肤缝线外渗。切口脂肪液化（D错）多发生在术后5～7天，大部分病人除诉切口有较多渗液外，无其它自觉症状；部分病人于常规检查切口时发现敷料上有黄色渗液，按压切口皮下有较多渗液。